砷中毒引起的皮肤色素异常主要发生在
A. 面部
B. 眼睑、腋窝等皱褶处
C. 腹背部
D. 四肢皮肤
E. 裸露皮肤部位

正确答案：C。腹背部

解析：本题考查砷中毒引起的皮肤色素异常主要发生的部位。砷中毒引起的皮肤色素异常主要发生在躯干部位，以腹部（花肚皮）、背部为主（C对ABDE错），也可出现在乳晕、眼脸、腋窝等皱褶处。